患者，左上7铸造全冠修复后2个月松动脱落，检查：预备体良好，咬合检查发现近中舌尖有明显早接触点。正确的处理是
A. 调对颌牙尖
B. 调对颌早接触点
C. 使用更优质的粘接剂粘固
D. 调全冠上的早接触点，抛光后重新粘固
E. 重做全冠

正确答案：D。调全冠上的早接触点，抛光后重新粘固

解析：本题考查牙体缺损修复的调改。修复体松动脱落尽早仔细分析松动原因，根据病因进行处理，不必重做全冠（E错）。患牙全冠修复就位后出现早接触，应对早接触进行调改，抛光后重新粘固（D对）。调对颌牙尖（A错）和调对颌早接触点（B错）会降低咬合高度，使咬物无力，降低咀嚼效率。使用优质的粘接剂粘固（C错）未能消除早接触，患牙仍会因为咬合不平衡而松动脱落。